预防性实验研究的流行病学效果评价指标是
A. 有效率、效果指数
B. 保护率、效果指数
C. 抗体阳转率、有效率
D. 有效率、生存率
E. 有效率、保护率

正确答案：B。保护率、效果指数